下列哪项不是生长素对机体的作用
A. 促进骨骼和肌肉生长
B. 促进蛋白质合成
C. 加速糖利用
D. 加速脂肪氧化
E. 促进神经系统发育

正确答案：E。促进神经系统发育